正常初生小儿的体重、身长约为
A. 2㎏ 30㎝
B. 2.5㎏ 40㎝
C. 3㎏ 50㎝
D. 4㎏ 60㎝
E. 4.5㎏ 70㎝

正确答案：C。3㎏ 50㎝

解析：小儿初生体重平均约3kg，身长约50cm(C对)。少数小儿初生体重2㎏身长30㎝，不具备共性（A错）。少数小儿初生体重2.5㎏身长40㎝，不具备共性（B错）。少数小儿初生体重4㎏身长60㎝，不具备共性（D错)。少数小儿初生体重4.5㎏身长70㎝，不具备共性（E错）。